有关颈内动脉的描述，正确的是
A. 左侧的起于主动脉弓
B. 右侧的起于头臂干
C. 经颈动脉管入颅
D. 入颅后发出脑膜中动脉营养硬脑膜
E. 入颅前发出眼动脉营养眼球

正确答案：C。经颈动脉管入颅

解析：颈内动脉在颈部无分支（AB错）。经颈动脉管入颅（C对），分支分布于视器和脑。